患者腹痛、腹泻4天，大便呈黏液脓血便，伴发热恶寒，全身不适，恶心呕吐。应首先考虑的是
A. 急性肠炎
B. 大肠癌
C. 阿米巴痢疾
D. 细菌性痢疾
E. 霍乱

正确答案：D。细菌性痢疾

解析：患者以腹痛、腹泻4天为主症，伴发热恶寒，全身不适，恶心呕吐，排粘液脓血便等细菌性痢疾的典型表现，应首先考虑的诊断为细菌性痢疾（D对）。急性肠炎（A错）主要表现为发热、腹痛、腹泻及黏液血便，少数可出现程度不等的神经病变，没有里急后重感。大肠癌（B错）早期无症状，或症状不明显，仅感不适、消化不良、大便潜血等，随着癌肿发展，症状逐渐出现，表现为大便习惯改变、腹痛、便血、腹部包块、肠梗阻等，伴或不伴贫血、发热和消瘦等全身症状，肿瘤因转移、侵润可引起受累器官的改变。阿米巴痢疾（C错）起病缓慢，全身症状较轻，无发热或仅有低热，主要表现为腹泻，每日3～10次，呈暗红色果酱样，常不伴有里急后重。霍乱（E错）临床上为无痛性泻吐，以剧烈的腹泻继之以呕吐米泔水样物为特征，大便亦呈米泔水样，且不发热，多无腹痛，常很快出现脱水、酸中毒及周围循环衰竭；粪便培养霍乱弧菌阳性可确诊。